支气管哮喘时增多的细胞是
A. 中性粒细胞
B. 嗜酸性粒细胞
C. 嗜碱性粒细胞
D. 淋巴细胞
E. 单核细胞

正确答案：B。嗜酸性粒细胞

解析：嗜酸性粒细胞增多常见于（1）变态反应性疾病如支气管哮喘、荨麻疹、药物过敏、过敏性紫癜等。（2）寄生虫感染如血吸虫病、蛔虫病、钩虫病等。（3）某些皮肤病如湿疹、剥脱性皮炎、天疱疮、银屑病等。（4）某些血液病如慢性粒细胞白血病、多发性骨髓瘤、嗜酸粒细胞白血病、淋巴瘤、嗜酸性粒细胞肉芽肿等。（5）某些恶性肿瘤某些上皮系肿瘤如肺癌等。（6）某些传染病如猩红热等。（7）其他风湿性疾病、脑腺垂体功能减低症、肾上腺皮质功能减低症、过敏性间质性肾炎等（B对）。中性粒细胞增多：生理性增多见于新生儿、妊娠末期及分娩时，剧烈运动、劳动，饱餐，沐浴后及寒冷等。病理性增多大致分为反应性增多和异常增生性增多两大类（A错）。嗜碱粒细胞增多见于变态反应性疾病、慢性粒细胞白血病、嗜碱粒细胞白血病、转移癌、骨髓纤维化、慢性溶血等（C错）。淋巴细胞增多见于①感染性疾病：主要为病毒感染，如麻疹、风疹、水痘、流行性腮腺炎、传染性单核细胞增多症、病毒性肝炎、肾综合征出血热等。也可见于某些杆菌感染，如结核病、百日咳、布氏菌病。②某些血液病：如急、慢性淋巴细胞白血病及淋巴瘤等。③其他：急性传染病的恢复期、移植排斥反应等（D错）。单核细胞增多见于：①生理性：<2周的新生儿可达0.15或更多，儿童平均为0.09。②病理性：某些感染，如亚急性感染性心内膜炎、活动性结核病、疟疾、急性感染的恢复期；某些血液病，如单核细胞白血病、粒细胞缺乏症恢复期、多发性骨髓瘤和淋巴瘤等（E错）。